关于克拉维酸的说法，错误的是
A. 克拉维酸是由内酰胺环和氢化异唑环并合而成，环张力比青霉素大，更易开环
B. 克拉维酸和阿莫西林组成的复方制剂，可使阿莫西林增效
C. 克拉维酸可单独用于治疗耐阿莫西林细菌所引起的感染
D. 克拉维酸与头孢菌素类抗生素联合使用时，可使头孢菌素类药物增效
E. 克拉维酸是一种“自杀性”的酶抑制剂

正确答案：C。克拉维酸可单独用于治疗耐阿莫西林细菌所引起的感染

解析：本题考查克拉维酸。克拉维酸和阿莫西林组成的复方制剂（C错，为本题正确答案），可使阿莫西林增效130倍（B对）。克拉维酸是由内酰胺环和氢化异唑环并合而成，张力比青霉素大（A对）。克拉维酸也可与其它β-内酰胺类抗生素联合使用，可使头孢菌素类增效（D对）2～8倍。克拉维酸易与β-内酰胺酶中亲核基团反应，进行不可逆的烷化，使β-内酰胺酶彻底失活，是一种“自杀性”的酶抑制药（E对）。